一般不宜使用糖皮质激素类药物的疾病为
A. 败血症
B. 过敏性休克
C. 支气管哮喘
D. 腮腺炎
E. 多发性心肌炎

正确答案：D。腮腺炎

解析：糖皮质激素没有抗病毒的作用，病毒性感染一般不用，且用后降低机体的防御功能而使感染扩散，腮腺炎由病毒引起，故腮腺炎（D错，为本题正确答案）一般不用；糖皮质激素对各种原因引起的机体炎症反应以及炎症的不同阶段均有强大的抑制作用，可用于治疗严重急性感染并伴有明显中毒或休克症状者，如败血症（A对）；糖皮质激素还适用于各种休克，对过敏性休克（B对）是次选药，必要时与首选肾上腺素合用；支气管哮喘（C对）急性发作可首先选用糖皮质激素的吸入制剂，因其局部用药不仅减少吸收，使全身不良反应减少，而且能有效地控制哮喘症状；对多发性心肌炎（E对），应用糖皮质激素治疗可缓解症状，一般采用综合疗法，不宜单用，以免引起不良反应。